下列关于火热内生机理的叙述，错误的是
A. 气有余便是火
B. 邪郁化火
C. 五志过极化火
D. 精亏血少，阴虚阳亢
E. 外感暑热阳邪

正确答案：E。外感暑热阳邪

解析：本题考查火热内生的机理，属于理解记忆内容。外感暑热阳邪属于外感六淫的范畴，不属于内生五邪的范围（E错，为本题正确答案）。内生五邪由脏腑及精气血津液功能失常而产生；外感六淫由自然界的气候变化失常而产生。火热内生有虚实之分，其病机主要有如下几方面1.阳气过盛化火（A对）；2.邪郁化火（B对）；3.五志过极化火（C对）；4.阴虚火旺（D对）。